亚健康状态是指
A. 慢性疲劳综合症
B. 虽然无临床症状，但各种检查可以发现阳性结果
C. 介于健康和疾病之间的一种第三状态
D. 无症状疾病
E. 机体出现亚临床损害

正确答案：C。介于健康和疾病之间的一种第三状态